最常见的女性生殖器结核是
A. 子宫内膜结核
B. 卵巢结核
C. 输卵管结核
D. 宫颈结核
E. 盆腔结核

正确答案：C。输卵管结核

解析：最常见的女性生殖器结核是输卵管结核（C对），占女性生殖器结核的90%～100%。子宫内膜结核（P265）（A错）占女性生殖器结核的50%～80%。卵巢结核（P265）（B错）占女性生殖器结核的20%～30%。宫颈结核（P265）（D错）较少见，占女性生殖器结核的10%～20%。盆腔腹膜结核（P265）（E错）多合并输卵管结核。